以下关于尖牙保护（牙合）的叙述中，不恰当的是
A. 根长且粗大，支持力强是尖牙的有利条件
B. 尖牙位居牙弓前部，在咀嚼时构成第Ⅲ类杠杆，能抵御较大的咀嚼力
C. 是以成组的牙齿行使功能
D. 以尖牙作支撑，对其他牙齿起到保护作用
E. 正中关系（牙合）与正中（牙合）协调

正确答案：C。是以成组的牙齿行使功能

解析：本题考查（牙合）分类及临床意义与面部结构。组牙功能（牙合）是以成组的牙齿行使功能（C错，为本题正确答案）。